Ⅱ型强心苷的苷元和糖的连接方式是
A. 苷元-（D-葡萄糖）
B. 苷元-（6-去氧糖甲醚），-（D-葡萄糖）
C. 苷元-（2，6-二去氧糖），-（D-葡萄糖）
D. 苷元-（6-去氧糖），-（D-葡萄糖）
E. 苷元-（D-葡萄糖），-（2，6-二去氧糖）

正确答案：D。苷元-（6-去氧糖），-（D-葡萄糖）